无偿献血应符合以下哪项规定
A. 在保证临床用血的前提下，可以出售给单采血浆站
B. 在保证临床用血的前提下，可以出售给血液制品生产单位
C. 由血站自主决定
D. 必须用于临床
E. 由卫生行政部门根据情况确定

正确答案：D。必须用于临床

解析：《献血法》国家实行无偿献血制度。国家提倡18周岁至55周岁的健康公民自愿献血。献血应当保证临床用血需要和安全，保障献血者和用血者身体健康。掌握“无偿献血、医疗机构和血站职责及法律责任”知识点。